男性，30岁。持续高热2周，血培养找到伤寒杆菌，其高热24小时体温相差不到1℃，但最低未达正常，此热型为下列哪一种
A. 稽留热
B. 弛张热
C. 间歇热
D. 回归热
E. 马鞍热

正确答案：A。稽留热